能溶于酸水，而且显红色的是
A. 黄芩苷
B. 黄芩苷苷元（黄芩素）
C. 槲皮素
D. 槲皮素-7-O-葡萄糖苷
E. 矢车菊素

正确答案：E。矢车菊素

解析：本题考查的是黄酮类化合物的性状。能溶于酸水，而且显红色的是矢车菊素（E对）。花色素及其苷元的颜色随pH不同而改变，一般显红色（pH＜7）、紫色（pH=8.5）、蓝色（pH＞8.5）等颜色。黄芩苷（A错）、黄芩苷苷元（黄芩素）（B错）属于黄酮类化合物，槲皮素（C错）、槲皮素-7-O-葡萄糖苷（D错）属于黄酮醇类化合物，均不会在酸水中显红色。一般情况下，黄酮、黄酮醇及其苷类多显灰黄色至黄色，查耳酮为黄色至橙黄色，而二氢黄酮、二氢黄酮醇异黄酮类，因不具有交叉共轭体系或共轭链较短，故不显色（二氢黄酮及二氢黄酮醇）或显浅黄色（异黄酮）。特别指出的是，在上述黄酮、黄酮醇分子中，尤其在7-位及4'-位引入-OH及-OCH₃等助色团后，则因有促进电子移位、重排作用，而使化合物的颜色加深。如果-OH、-OCH₃引入其他位置，则影响较小。